下列不符合二尖瓣狭窄患者的描述的选项是
A. 两颧绀红色
B. 肺动脉段膨出
C. 左心房增大
D. 严重时发生急性肺水肿
E. 心音弱而远

正确答案：E。心音弱而远

解析：大量心包积液时，常见的体征有心音弱而远（E错，为本题正确答案）。二尖瓣狭窄患者早期由于左心房的血液流入左心室受阻，而导致左心房压升高，严重狭窄时左心房压需高达20～25mmHg才能使血流通过狭窄的瓣口，使左心室充盈并维持正常的心排出量，因此左心房会出现代偿性肥厚和扩张，出现左心房增大（C对）。随着疾病的发展，左心房压增高引起的肺静脉压力增高导致肺动脉压力增高，而长期肺动脉高压引起引起肺小动脉痉挛，最终导致肺小动脉硬化，更加重肺动脉高压，从而在X线表现为肺动脉段膨出（B对）。严重二尖瓣狭窄（P287）时可呈“二尖瓣面容”，表现为两颧绀红色（A对）；也可因剧烈体力活动或情绪激动、感染等诱发急性肺水肿（D对），如不及时救治，可能致死。